按外科辨证，下列各项属阳证的是
A. 肿块软硬，溃后渐消
B. 局部紫暗或皮色不变
C. 疮形平坦下陷
D. 脓液稀薄或线血水
E. 肿胀范围不局限，根脚散漫

正确答案：A。肿块软硬，溃后渐消

解析：肿块软硬，溃后渐消，属于阳证的辨别要点（A对）。局部紫暗或皮色不变、疮形平坦下陷、脓液稀薄或线血水、肿胀范围不局限，根脚散漫均为阴证的辨别要点（BCDE错）。